主要用作注射用无菌粉末的溶剂或注射液的稀释剂的制药用水是
A. 天然水
B. 饮用水
C. 纯化水
D. 注射用水
E. 灭菌注射用水

正确答案：E。灭菌注射用水

解析：本题考查灭菌注射用水。灭菌注射用水（E对）主要用于注射用灭菌粉末的溶剂或注射剂的稀释剂。饮用水（B错）为天然水（A错）经净化处理所得的水，可作为药材净制时的漂洗、制药用具的粗洗用水。除另有规定外，也可作为药材的提取溶剂。纯化水（C错）可作为配制普通药物制剂的溶剂或试验用水，口服、外用制剂配制用溶剂或稀释剂。纯化水不得用于注射剂的配制与稀释。注射用水（D错）可作为注射剂、滴眼剂等的溶剂或稀释剂及容器的清洗溶剂。